用于亚硝酸盐食物中毒解救的是
A. 1：5000高锰酸钾溶液
B. 1%亚甲蓝注射液
C. 维生素C注射液
D. 葡萄糖注射液
E. 维生素K₁注射液

正确答案：A、B、C、D。1：5000高锰酸钾溶液；1%亚甲蓝注射液；维生素C注射液；葡萄糖注射液

解析：本题考查亚硝酸盐中毒解救。亚硝酸盐中毒可引起高铁蛋白血症，中毒不长的首先用1：5000高锰酸钾液洗胃，导泄并灌肠并予以1%亚甲蓝注射液配葡萄糖液静脉滴注，或与维生素C注射液联合应用。维生素K₁（E错）是香豆素类灭鼠药中毒的特效解毒剂。